同时具有产生抗体和抗原提呈功能的免疫细胞是
A. NK细胞
B. 树突细胞
C. T细胞
D. B细胞
E. 巨噬细胞

正确答案：D。B细胞

解析：本题考查免疫细胞。同时具有产生抗体和抗原提呈功能的免疫细胞是B细胞（D对）。树突细胞（B错）是抗原提呈功能最强的细胞，但其与NK细胞（A错）、T细胞（C错）及巨噬细胞（E错）均不是同时具有产生抗体和抗原提呈功能的免疫细胞。